下列何种原因引起的缺氧不属于循环性缺氧
A. 休克
B. 心力衰竭
C. 肺动－静脉瘘
D. 动脉血栓形成
E. 静脉淤血

正确答案：C。肺动－静脉瘘

解析：引起循环性缺氧的原因有：①全身性循环障碍 见于心力衰竭（B对）、休克（A对）和静脉淤血（E对）等。②局部性循环障碍 见于动脉硬化、血管炎、血栓形成（D对）和栓塞、血管痉挛或受压等。肺动-静脉瘘（C错，为本题正确答案）是引起乏氧性缺氧的原因。